癌症患者常见的心理变化不包括
A. 休克-恐惧期
B. 否认-怀疑期
C. 愤怒-沮丧期
D. 接受-适应期
E. 否认-适应期

正确答案：E。否认-适应期

解析：癌症患者常见的心理变化包括：休克-恐惧期；否认-怀疑期；愤怒-沮丧期；接受-适应期。掌握“特殊患者心理”知识点。